针对病毒某些表面抗原的抗体能够与细胞外游离的病毒结合后从而消除病毒感染能力，此类抗体称为
A. 干扰素
B. 中和抗体
C. 单克隆抗体
D. 抗毒素
E. 抗菌抗体

正确答案：B。中和抗体

解析：中和抗体：指针对病毒某些表面抗原的抗体。此类抗体能与细胞外游离的病毒结合后从而消除病毒感染能力。掌握“病毒传播方式、感染类型、致病机制及免疫”知识点。